下列哪个参数最能表示药物的安全性
A. 最小有效量
B. 极量
C. 半数致死量
D. 半数有效量
E. 治疗指数

正确答案：E。治疗指数

解析：药物的半数致死量（LD50）和半数有效量（ED50）的比值成为治疗指数。此数值越大越安全。掌握“药物与受体、剂量与效应关系”知识点。